普拉洛尔（心得宁）上市后，临床使用中发生的严重不良反应是
A. 再生障碍性贫血
B. 黄疸
C. 眼-黏膜-皮肤综合征
D. 假膜性结肠炎
E. 血栓栓塞

正确答案：E。血栓栓塞